管理头面部皮肤的感觉
A. 三叉神经
B. 舌下神经
C. 面神经
D. 舌咽神经
E. 舌神经

正确答案：A。三叉神经

解析：三叉神经（A对）的三叉神经感觉根，自脑桥基底部与小脑中脚交界处入脑，传导头面部痛温觉。舌下神经（B错）支配舌内肌和大部分舌外肌。面神经（C错）主要支配面部表情肌。舌咽神经（D错）支配茎突咽肌。舌神经（E错）含一般躯体感觉纤维，于下颌支内侧成弓状下降至口腔底，分布于口腔底和舌前2/3的黏膜，管理舌前2/3的感觉。舌下神经（B错）支配舌内肌和大部分舌外肌。